圈形卡环多用于
A. 牙冠外形差的基牙
B. 游离缺失的末端基牙
C. 远中孤立的磨牙
D. 孤立的双尖牙
E. 松动的基牙

正确答案：C。远中孤立的磨牙

解析：圈形卡环：多用于远中孤立的磨牙上，上颌磨牙向近中颊侧倾斜、下颌磨牙向近中舌侧倾斜者。卡环臂的尖端在上颌磨牙的颊侧和下颌磨牙的舌侧。铸造的圈形卡有近、远中两个（牙合）支托。远中（牙合）支托有增加支持，防止基牙进一步倾斜移位作用。非倒凹一侧卡环臂有辅助臂与支架相连，可增加卡环臂的强度。掌握“局部义齿固位体”知识点。